行于气管食管沟内的是
A. 迷走神经
B. 喉上神经
C. 喉返神经
D. 颈交感干
E. 臀下神经

正确答案：C。喉返神经

解析：左、右喉返神经（C对）分别行于两侧气管与食管之间的沟内或附近，有甲状腺下动脉与其伴行。左迷走神经（A错）在左颈总动脉与左锁骨下动脉之间下行，越过主动脉弓前方，经左肺根后方至食管前面下行并分成许多细支，构成左肺丛和食管前丛。喉上神经（B错）于颈内动脉内侧下行，在舌骨大角处分为内、外两支。颈交感干（D错）位于颈血管鞘后方，颈椎横突的前方。臀下神经（E错）伴随臀下血管经梨状肌下孔出盆腔至臀部，行于臀大肌深面。